健康育龄期妇女出现恶心、食欲减退等消化道症状，问诊时不应忽视的是
A. 胃炎病史
B. 肝炎病史
C. 传染病史
D. 不洁饮食史
E. 月经史

正确答案：E。月经史

解析：恶心、食欲减退等消化道症为典型早孕反应，不应忽视患者月经史（E对）。健康育龄期妇女出现恶心、食欲减退等消化道症状亦可考虑胃炎病史（A错）、肝炎病史（B错）、传染病史（C错）、不洁饮食史（D错）。